窝洞制备的基本要求是
A. 去净龋坏组织
B. 固位形，抗力形
C. 少切割牙体组织
D. 保护牙髓
E. 以上都是

正确答案：E。以上都是

解析：本题考查窝洞预备的基本要求。窝洞预备的基本要求：为了消除感染及刺激物，终止龋病发展，原则上必须去净龋坏组织（A对），确保充填体与洞壁紧贴，防止继发龋发生。为了防止充填体移位脱落或折裂，窝洞应兼顾抗力形和固位形（B对）。保存健康的牙体组织，不仅对充填体的固位很重要，还可使剩余的牙体组织有足够强度，以承担咀嚼压力（C对）。窝洞预备时切割牙体组织对牙髓牙本质复合体可产生机械、压力和温度刺激，要尽量减少对牙髓的刺激，保护牙髓组织（D对）。（ABCD均对，故E为本题的正确答案）。